人类活动造成的环境污染的主要来源是
A. 生产性污染，生活性污染，森林性污染
B. 农业性污染，生活性污染，交通性污染
C. 生产性污染，生活性污染，交通运输工具
D. 生产性污染，生活性污染，地震
E. 工业性污染，生活性污染，交通运输工具

正确答案：C。生产性污染，生活性污染，交通运输工具

解析：人类活动造成的环境污染的主要来源是生产性污染，生活性污染，交通运输工具（C对）。森林性污染（A错）、地震（D错）属于自然因素产生的环境污染的来源。根据课本上总结环境有害因素的来源，我们可以将人类活动造成的环境污染的主要来源总结为：①生产性污染源（包括工业生产和农业生产）：②生活性污染源：③交通运输性污染源：④其他污染源。